患儿，4岁。两日来发热不退，咳喘痰黄，声高息涌，呼气延长。其证候是
A. 风热咳嗽
B. 痰热咳嗽
C. 痰热闭肺
D. 风热闭肺
E. 热性哮喘

正确答案：E。热性哮喘

解析：辨证本证多为外感风热，引动伏痰，痰热相结，阻于气道而发作，故见发热不退，咳喘痰黄，声高息涌，呼气延长（E对）。风热咳嗽应见咳嗽不爽，痰黄黏稠，发热恶风，舌红苔薄黄，脉浮数（A错）。痰热咳嗽应见咳痰多，色黄黏稠，难以咯出，舌红苔黄腻，脉滑数（B错）。痰热闭肺应见发热烦躁，咳嗽喘促，呼吸困难，气急鼻煽，喉间痰鸣，口唇紫绀，面赤口渴，舌红苔黄，脉弦滑，无恶风、恶寒等表证（C错）。风热闭肺应见初起证候稍轻，发热恶风，咳嗽气急，痰多，痰稠黏或黄，口渴咽红，舌红，苔薄白或黄，脉浮数（D错）。